温中止泻宜煨用的药是
A. 金樱子
B. 乌贼骨
C. 罂粟壳
D. 补骨脂
E. 肉豆蔻

正确答案：E。肉豆蔻

解析：本题考查的是肉豆蔻的用法用量。温中止泻宜煨用的药是肉豆蔻（E对）。肉豆蔻：【用法用量】内服：煎汤，3～10g；入丸散，每次1.5～3g。温中止泻宜煨用。金樱子（A错）：【用法用量】内服：煎汤，6～12g；或入丸散。乌贼骨（B错）为海螵蛸的别名。海螵蛸：【用法用量】内服：煎汤，5～10g；研末，每次1.5～3g。外用：适量，研末敷。罂粟壳（C错）：【用法用量】内服：煎汤，3～6g；或入丸散。止咳宜蜜炙用，止泻、止痛宜醋炒用。补骨脂（D错）：【用法用量】内服：煎汤，6～10g；或入丸散。外用：适量，可制成20%～30%酊剂涂患处。